与水体富营养化有关的主要是下列哪种家用化学品
A. 化妆品
B. 洗涤剂
C. 涂料
D. 粘合剂
E. 杀虫剂

正确答案：B。洗涤剂

解析：本题考查与水体富营养化有关的家用化学品。由于大量使用合成洗涤剂（B对ACDE错），其中部分产品的磷酸盐含量高达30%～60%，使污水中磷含量显著增加，为水生植物提供充足的营养物质。受含磷、氮等污水污染造成水体中藻类大量繁殖，使水中有机物增加、溶解氧下降，水质恶化的现象，形成水体富营养化。